牙本质中按体积计算，无机物、有机物和水分的含量约
A. 30%、30%、40%
B. 40%、40%、20%
C. 50%、30%、20%
D. 60%、30%、10%
E. 70%、20%、10%

正确答案：C。50%、30%、20%

解析：本题考查牙本质的理化性质。牙本质中按体积计算，无机物、有机物和水分的含量约50%、30%、20%（C对）。成熟牙本质重量的70%为无机物，有机物为20%，水为10%。如按体积计算，无机物、有机物和水分的含量约为50%、30%和20%。